可能是损伤了
A. 右侧蜗神经
B. 左侧蜗神经
C. 双侧蜗神经耳背、腹核
D. 右侧颞横回
E. 右侧听辐射

正确答案：A。右侧蜗神经

解析：患者右侧听力丧失的原因是损伤了听觉传导通路。该通路的第1级神经元为蜗神经节内的双极神经细胞。第2级神经元胞体在蜗腹侧核和蜗背侧核内，形成外侧丘系（C错）。第3级神经元胞体在下丘核。第4级神经元胞体在内侧膝状体，发出纤维组成听辐射。所以右侧听力丧失可能是损伤了右侧蜗神经（A对），双侧蜗神经耳背、腹核（C错）损伤会导致双耳听力丧失。右侧颞横回（D错）或右侧听辐射（E错）损伤会致左耳听力损伤。